男孩，3岁。因水肿伴尿少5天入院，血浆白蛋白25g/L，RBC2～3/HP，血压100/90mmHg，下肢凹陷性水肿。可能的诊断是
A. 肾炎性肾病
B. 单纯性肾病综合征
C. 急进性肾炎
D. 急性肾炎
E. 慢性肾炎

正确答案：B。单纯性肾病综合征

解析：该患儿可能的诊断应为单纯型肾病综合症。题中患儿有明显的低蛋白血症（血浆白蛋白25g/L）、和水肿（下肢凹陷性水肿），应考虑肾病综合症。而肾病综合征依据临床表现可分为单纯型肾病综合症和肾炎性肾病。前者临床表现仅以①大量蛋白尿；②低蛋白血症；③高脂血症；④明显水肿为主，而后者则需要在前者的基础上加上①离心尿检查红细胞≥10个/HPF；②血压≥130/90mmHg；③肾功能不全，并排除由于血容量不足等所致；④持续低补体血症。可见本题中患儿应为单纯型肾病综合症（B对），而非肾炎性肾病（A错）。